对于融合牙的治疗，以下说法正确的是
A. 对牙列影响不大，可不做处理
B. 融合线处应该切割为两个独立牙冠
C. 替牙后融合牙未脱落，应拔除
D. 继承恒牙无法萌出时，应保留
E. 融合牙应该使用全冠修复改变其外观形态

正确答案：A。对牙列影响不大，可不做处理

解析：本题考查融合牙的治疗。对于融合牙的治疗，说法正确的是对牙列影响不大，可不做处理（A对）。融合牙（fused tooth）常由两个正常牙胚融合而成，在牙齿发育期可以是完全融合的，也可以是不完全融合的。融合线处可通过窝沟封闭预防龋齿，也可做预防性充填（B错）。替牙前后应拍摄X线片检查有无恒牙先天缺失，及时进行间隙管理（C错）。发生在乳前牙区的融合牙，可能影响继承恒牙萌出，应定期观察。参考X线片，已达到继承恒牙萌出时间，但融合牙仍滞留者，可考虑拔除（D错）。发生在上颌前牙区的融合牙，由于牙大且在联合处有深沟，对美观有影响，应该应用复合树脂处理（E错）。